《素问·阴阳别论》有“二阳之病发心脾，有不得隐曲，女子不月”的记载，指出闭经与哪些脏器有关
A. 心、肝、脾
B. 肝、脾
C. 肺、脾、肾
D. 心、脾、肾
E. 心、肺、肾

正确答案：A。心、肝、脾

解析：历代医著对闭经的研究颇多，《素问·阴阳别论》说：“二阳之病发心脾，有不得隐曲，女子不月。”指出闭经与脾胃功能和精神情志有关，即与心、肝、脾（A对）三脏有关，这也是对闭经病因病机的最早认识。